骑车带人
A. 易导致非故意伤害的行为
B. 易导致故意伤害的行为
C. 物质滥用行为
D. 不良饮食和体重控制行为
E. 缺乏体力活动行为

正确答案：A。易导致非故意伤害的行为